郁金不具有的功效是
A. 活血止痛
B. 行气解郁
C. 凉血清心
D. 利胆退黄
E. 消肿生肌

正确答案：E。消肿生肌

解析：本题考查的是郁金的功效。郁金不具有的功效是消肿生肌（E错，为本题正确答案）。郁金：【功效】活血止痛（A对），行气解郁（B对），凉血清心（C对），利胆退黄（D对）。消肿生肌为乳香的功效。乳香：【功效】活血止痛，消肿生肌。